根据《中华人民共和国药品管理法》，下列药品监督管理部门的做法中，不符合规定的是
A. 对药品生产企业进行认证后的跟踪检查
B. 对被检查人的技术秘密适当保密
C. 根据需要对药品质量进行抽查检验
D. 定期公告药品质量抽验结果
E. 对有证据证明可能危害人体健康的药品采取查封和扣押措施

正确答案：B。对被检查人的技术秘密适当保密

解析：本题考查药品的监督管理。根据《中华人民共和国药品管理法》，下列药品监督管理部门的做法中，不符合规定的是对被检查人的技术秘密适当保密（B错，为本题正确答案）。药品监督管理部门进行监督检查时，应当出示证明文件，对监督检查中知悉的商业秘密应当保密。药品监督管理部门根据监督管理的需要，可以对药品质量进行抽查检验（C对）。抽查检验应当按照规定抽样，并不得收取任何费用；抽样应当购买样品。所需费用按照国务院规定列支。对有证据证明可能危害人体健康的药品及其有关材料，药品监督管理部门可以查封、扣押（E对），并在七日内作出行政处理决定；药品需要检验的，应当自检验报告书发出之日起十五日内作出行政处理决定。国务院和省、自治区、直辖市人民政府的药品监督管理部门应当定期公告药品质量抽查检验结果（D对）；公告不当的，应当在原公告范围内予以更正。